一级预防包括
A. 降低或减少劳动者接触职业性有害因素水平
B. 通过健康监护，早期发现职业损害
C. 对职业病患者进行及时治疗和处理
D. 建立和健全组织领导机构
E. 对作业工人实施健康监护、早期发现职业损害

正确答案：A。降低或减少劳动者接触职业性有害因素水平

解析：本题考查第一级预防的内容。第一级预防又称病因预防，是从根本上消除或控制职业性有害因素对人的作用和损害（A对BCDE错），即改进生产工艺和生产设备，合理利用防护设施及个人防护用品，以减少或消除工人接触的机会。主要有如下几个方面：①改进生产工艺和生产设备；②职业卫生立法和有关标准、法规制定；③个人防护用品的合理使用和职业禁忌证的筛检；④控制已明确能增加发病危险的社会经济、健康行为和生活方式等个体危险因素。